部分注射药物性质不稳定，遇光易变色，在滴注过程中必须避光的有
A. 尼莫地平注射液
B. 注射用硝普钠
C. 氟康唑注射液
D. 注射用头孢曲松
E. 氧氟沙星注射液

正确答案：A、B、E。尼莫地平注射液；注射用硝普钠；氧氟沙星注射液

解析：本题考查避光保存的药物。易受光线影响而变质的药品有氨茶碱、尼莫地平注射液（A对）、硝普纳（B对）、左氧氟沙星注射液（E对）等。